念珠菌阴道炎主要传播方式是
A. 寄生在阴道、口腔和肠道的念珠菌可互相自身传染
B. 通过性交直接传染
C. 通过污染的衣物间接传染
D. 医源性传播
E. 经公共浴池传播

正确答案：A。寄生在阴道、口腔和肠道的念珠菌可互相自身传染